血浆晶体渗透压的主要生理作用是
A. 决定血浆的总渗透压
B. 维持毛细血管内外的水平衡
C. 影响血浆总量
D. 影响组织液的生成量
E. 保持细胞内外的水平衡

正确答案：E。保持细胞内外的水平衡

解析：血浆晶体渗透压升高，视上核及其周围区域渗透压感受器受刺激，使神经垂体释放抗利尿激素，集合管管腔膜对水通透性增加，水的重吸收增多，尿液浓缩，尿量减少。血浆晶体渗透压降低，引起抗利尿激素分泌减少，集合管对水的重吸收减少，尿液稀释，尿量增加。因此血浆晶体渗透压的主要生理作用是影响抗利尿激素分泌，保持细胞内外的水平衡（E对）。